间接致癌物是
A. β-丙烯内酯
B. β-萘胺
C. 镍
D. 佛波酯
E. 己烯雌酚

正确答案：B。β-萘胺